某患者，男，有不洁性交史，2月前出现生殖器皮肤的无痛性溃疡，1个月后自然愈合，近日出现全身皮肤红疹，伴有淋巴结肿大，该患者可能患有何病
A. 猩红热
B. 麻疹
C. 性病淋巴肉芽肿
D. 风疹
E. 梅毒

正确答案：E。梅毒